健康促进测量指标不仅是针对健康状况，而且要针对人群的
A. 生活方式
B. 生活质量
C. 健康观念
D. 社会环境
E. 社区行动

正确答案：B。生活质量